关于气雾剂特点的说法，正确的有
A. 能使药物直达作用部位
B. 生产成本较低
C. 可避免肝脏的首过效应
D. 可提高药物稳定性
E. 药物吸收干扰因素少

正确答案：A、C、D。能使药物直达作用部位；可避免肝脏的首过效应；可提高药物稳定性

解析：本题考查气雾剂的特点。气雾剂能直达药物作用部位，起效快（A对）；气雾剂直接吸入，可避免肝脏的首关效应（C对）；药物密闭于容器内能保持药物清洁无菌，且能提高药物的稳定性（D对）；气雾剂需要特殊生产设备，生产成本高（B错）；有多种因素干预或限制药物剂量，药物吸收干扰因素多（E错）。